牙冠延长术后制作修复体的一般在
A. 术后1～2周
B. 术后2～3周
C. 术后4～6周
D. 术后6～8周
E. 术后8～12周

正确答案：C。术后4～6周

解析：牙冠延长术后修复体的制作一般在术后4～6周，此时组织愈合、龈缘位置基本稳定。涉及美容的修复应至少在术后2个月后开始。如果过早修复，往往会干扰组织的正常愈合，并在组织充分愈合后导致修复体边缘的暴露。掌握“牙周健康与修复”知识点。